抗原的免疫原性是指能够刺激机体的免疫系统发生免疫应答
A. 产生抗体的能力
B. 产生致敏淋巴细胞的能力
C. 产生抗体或致敏淋巴细胞的能力
D. 与相应抗体特异性结合的能力
E. 与相应致敏淋巴细胞特异性结合的能力

正确答案：C。产生抗体或致敏淋巴细胞的能力